患者，女性，25岁。因心脏手术，麻醉药过量，病人出现呼吸、心脏骤停，此时除进行人工呼吸及心脏按压外，应采取哪项急救措施
A. 静注毛花苷丙
B. 静滴去甲肾上腺素
C. 心内注射阿托品
D. 心内注射肾上腺素
E. 静注异丙肾上腺素

正确答案：D。心内注射肾上腺素